对服用5-HT再摄取抑制剂所引起的性功能障碍的抑郁症患者，可更换应用
A. 氟伏沙明
B. 帕罗西汀
C. 文拉法辛
D. 阿米替林
E. 托莫西汀

正确答案：D。阿米替林

解析：本题考查药物的不良反应。对服用5-HT再摄取抑制剂所引起的性功能障碍的抑郁症患者，可更换应用阿米替林（D对）。阿米替林的不良反应不包括性功能障碍。氟伏沙明（A错）、帕罗西汀（B错）、文拉法辛（C错）的不良反应均包括性功能障碍。托莫西汀（E错）用于治疗儿童和青少年的注意缺陷/多动障碍，不用于治疗抑郁症。